男，65岁。腹部手术后出现疼痛，使用吗啡镇痛治疗，复查血气示pH7.32，PaCO₂50mmHg，PaO₂54mmHg，该患者低氧血症最可能的发生机制是
A. 肺内分流
B. 氧耗量增加
C. 肺泡通气量下降
D. 弥散功能障碍
E. 通气/血流比例失衡

正确答案：C。肺泡通气量下降

解析：该患者男，65岁，既不是一型呼衰也不是二型呼衰。吗啡抑制呼吸肌运动，导致肺通气量不足——肺泡通气量不足。这里问的是最主要的机制（C对ABDE错）。